揩舌主要判断的是
A. 是否属于染苔
B. 是否光线影响
C. 是否里有实邪
D. 是否舌质润泽
E. 是否运动灵活

正确答案：A。是否属于染苔

解析：揩舌，可用消毒棉签菌少许清水在舌面上揩抹数次。可用于鉴别舌苔有根无根，以及是否属于染苔(A对）。